恶性淋巴瘤的治疗应首选
A. 手术加化疗
B. 手术加放疗
C. 化疗加放疗
D. 中药治疗
E. 热疗

正确答案：C。化疗加放疗

解析：本题考查恶性淋巴瘤的治疗。恶性淋巴瘤对放疗和化疗都比较敏感，治疗应首选化疗加放疗（C对）。霍奇金淋巴瘤早期以放疗为主，晚期以化疗为主。非霍奇金淋巴瘤由于容易全身播散，故一般应以化疗为主，放疗为辅。手术（AB错），中药治疗（D错），热疗（E错）可以作为辅助手段，不能作为首选方法。